患者心下痞满，不欲饮食，倦怠乏力，大便不调，舌淡苔白腻，脉沉弦。治疗应选用
A. 保和丸
B. 健脾丸
C. 枳实消痞丸
D. 枳术丸
E. 木香槟榔丸

正确答案：C。枳实消痞丸

解析：患者心下痞满，不欲饮食，倦怠乏力，大便不调，舌淡苔白腻，脉沉弦。因脾胃素虚，升降失职，寒热互结，气壅湿聚所致。方用枳实消痞丸。枳实行气消痞，厚朴行气除満，黄连清热燥湿而除痞，半夏散结而和胃，干姜温中散寒，麦芽消食和胃，人参、白术、茯苓、炙甘草益气健脾，祛湿和中（C对）。保和丸方证因饮食不节，暴饮暴食所致。为治一切食积的常用方（A错）。健脾丸方证因脾虚胃弱，运化失常，食积停滞，郁而生热所致。为治脾虚食滞的常用方（B错）。枳术丸为健脾化积除痞之剂（D错）。木香槟榔丸多由饮食积滞内停，气机壅塞，郁而化热所致。（E错）。